有关蛋白质二级结构的叙述，正确的是
A. 氨基酸的排列顺序
B. 每一氨基酸侧链的空间构象
C. 局部主链的空间构象
D. 亚基间相对的空间位置
E. 每一原子的相对空间位置

正确答案：C。局部主链的空间构象

解析：本题考查蛋白质的二级结构。蛋白质的二级结构是指蛋白质分子中某一段肽链的局部空间结构，也就是该段肽链主链骨架原子的相对空间位置（C对），并不涉及氨基酸残基侧链的构象（B错）。氨基酸的排列顺序（A错）决定蛋白质的一级结构。整条肽链上每一原子的相对空间位置（E错）决定蛋白质的三级结构。亚基间相对的空间位置（D错）决定蛋白质的四级结构。